城市中学布点时，服务半径为学生走路上学需
A. 5分钟左右
B. 10分钟左右
C. 15分钟左右
D. 20分钟左右
E. 15～20分钟

正确答案：E。15～20分钟